下列不是牙与牙之间紧密邻接的意义的是
A. 在咀嚼运动中互相支持
B. 分散咀嚼压力
C. 提高咀嚼效能
D. 不利于牙的稳固
E. 避免食物嵌塞

正确答案：D。不利于牙的稳固

解析：牙列生理意义：牙与牙之间紧密邻接，在咀嚼运动中互相支持、分散咀嚼压力、提高咀嚼效能，而且避免食物嵌塞，有利于牙的稳固。牙体的倾斜方向使咀嚼产生的力沿着牙体长轴传导，有利于咀嚼能力的发挥和维护牙周组织健康；使上下牙列之间广泛而紧密地接触，有利于咀嚼，并避免咬伤黏膜。牙体的倾斜有利于衬托唇颊，使口腔本部较大，便于舌的活动，保持面下1/3丰满。掌握“牙列”知识点。